正确描述大隐静脉的是
A. 起于足背静脉弓外侧部
B. 经外踝前方
C. 经膝关节内后方
D. 在耻骨结节内下方注入股静脉
E. 伴腓肠神经走行

正确答案：C。经膝关节内后方

解析：大隐静脉在足内侧缘（A错）起自足背静脉弓，经内踝（B错）前方，沿小腿内侧面、膝关节内后方（C对）、大腿内侧面上行，至耻骨结节外下方（D错）3-4cm处穿阔筋膜的隐静脉裂孔，注入股静脉。